儿童、青少年贫血主要是因为膳食中缺乏哪种矿物质
A. 铁
B. 钙
C. 锌
D. 锡
E. 镁

正确答案：A。铁